根据食物中毒的特点和原因，食物中毒的现场处理不包括
A. 封存、停止食用有毒食品
B. 实施行政控制措施
C. 治疗病人
D. 追回、销毁有毒食品
E. 追查和处理食物中毒责任人或单位

正确答案：C。治疗病人